心电图可出现T波高尖的电解质紊乱是
A. 低钾血症
B. 高钾血症
C. 高钠血症
D. 低钙血症
E. 低钠血症

正确答案：B。高钾血症

解析：可出现T波高尖的电解质紊乱是高钾血症（B对）。低钾血症（A错）T波降低、增宽或倒置。